女，15岁。肉眼血尿伴水肿1周。20天前患皮肤脓疱疮，抗感染治疗好转。查体：BP150/90mmHg，颜面及双下肢水肿。实验室检查：血Hb112g/L，WBC6.8×10⁹/L，NO.70，SCr130µmol/L，ASO滴度升高，C3降低。尿沉渣镜检RBC满视野，WBC5～8/HP。尿蛋白（＋＋）。最可能的诊断是
A. 肾病综合征
B. 急进性肾小球肾炎
C. 急性肾盂肾炎
D. 急性肾小球肾炎
E. IgA肾病

正确答案：D。急性肾小球肾炎

解析：患者青年女性，20天前患皮肤脓疱疮（急性肾小球肾炎诱因），查体：BP150/90mmHg（升高，正常≤140/90mmHg），颜面及双下肢水肿。实验室检查：SCr130µmol/L（升高，正常44～100μmol/L），ASO滴度升高（提示近期曾有链球菌感染），C3降低（8周内恢复正常对疾病有诊断意义）。尿沉渣镜检RBC满视野，尿蛋白（＋＋）。余无明显异常。根据患者的病史、临床表现、体征及实验室检查，最可能的诊断是急性肾小球肾炎（D对）。急进性肾小球肾炎（B错），是在急性肾炎综合征基础上，肾功能急剧恶化，患者起病急骤，早期即可出现少尿或无尿甚至尿毒症，可伴轻中度贫血（P468）。IgA肾病（E错），常表现为无症状性血尿，伴或不伴蛋白尿，起病前数小时或数日内有上呼吸道或消化道感染等前驱症状（P468）。肾病综合征（A错）临床以大量蛋白尿（＞3.5g/d），血清白蛋白＜30g/L，水肿及高脂血症为主要表现及诊断标准。急性肾盂肾炎（C错）患者起病急骤，全身高热、寒战，全身酸痛、恶心，尿频、尿急、尿痛、排尿困难，腰部钝痛。查体：肋脊角或输尿管点压痛。实验室检查尿液白细胞明显升高。